中医诊断用以分辨邪正盛衰的纲领是
A. 阴阳
B. 表里
C. 寒热
D. 虚实
E. 气血

正确答案：D。虚实

解析：本题考查的是八纲辨证。中医诊断用以分辨邪正盛衰的纲领是虚实（D对）。八纲辨证是各种辨证的总纲。八纲，即指阴、阳、表、里、寒、热、虚、实八类证候。八纲辨证就是把千变万化的病证，归纳为表与里、寒与热、虚与实、阴与阳四对纲领性证候，用以指导临床治疗。1.表证、里证：表里（B错）辨证是辨别病变部位和病势趋向的一种辨证方法。一般地说，病在皮毛、肌腠，部位浅在者属表证；病在脏腑、血脉、骨髓，部位深在者属里证。2.寒证、热证：寒热（C错），是辨析疾病性质的两个纲领。寒热也是阴阳偏盛偏衰的具体表现。一般地说，寒证是机体阳气不足或感受寒邪所表现的证候，热证是机体阳气偏盛或感受热邪所表现的证候。3.虚证、实证：虚实辨证，是分析辨别邪正盛衰的两个纲领。虚证，指人体正气不足所表现的证候。实证，是指邪气过盛所反映出来的一类证候。4.阴证、阳证：阴阳（A错）是八纲辨证的总纲，用以统括其余的六个方面。阴阳可以归纳表、里、寒、热、虚、实的六种证候。表、热、实证属阳证。里、寒、虚证属阴证。气血（E错）津液辨证，就是分析气、血、津液的病理变化，从而辨认其所反映的不同证候特点，为治疗选药的基础。